对多种氨基糖苷类钝化酶稳定的药物是
A. 磺胺嘧啶
B. 磺胺甲噁唑
C. 磺胺多辛
D. 甲氧苄啶
E. 磺胺米隆

正确答案：C。磺胺多辛